肝癌肝肾阴虚的中医治法为
A. 清利湿热，化瘀解毒
B. 疏肝理气，活血化瘀
C. 补气温阳，化瘀解毒
D. 益气养阴，化瘀解毒
E. 养阴柔肝，软坚散结

正确答案：E。养阴柔肝，软坚散结

解析：肝癌肝肾阴虚证的病机为癥积日久，阴血暗耗，肝阴亏虚，日久，累及肾阴，故中医治法为养阴柔肝，软坚散结（E对），方药为养阴柔肝的滋水清肝饮合软坚散结的鳖甲煎丸加减。清利湿热，化瘀解毒（A错），是湿热瘀毒证的治法，方药选用茵陈蒿汤合鳖甲煎丸加减；疏肝理气，活血化瘀（B错），是气滞血瘀证的治法，方药选用逍遥散合桃红四物汤加减；补气温阳，化瘀解毒（C错），是阳虚瘀毒证的治法；益气养阴，化瘀解毒（D错），是阴虚瘀毒证的治法。